凝胶剂的常用基质是
A. 硅酮
B. 硬脂酸钠
C. 聚乙二醇
D. 黄凡士林
E. 卡波姆

正确答案：E。卡波姆